下列有关暂时冠制作直接法说法错误的是
A. 减少就诊次数
B. 优点是快速、方便
C. 可即刻恢复患牙形态
D. 适用于多颗牙的暂时修复体制作
E. 用自凝树脂塑形时不易控制外形

正确答案：D。适用于多颗牙的暂时修复体制作

解析：在患者口腔内直接制作暂时修复体，其优点是快速、方便，可即刻恢复患牙形态，减少就诊次数。此法适用于单个或几颗牙的暂时修复体制作，其缺点是当预备牙及邻牙有较大倒凹时，或多个预备牙就位道不同时易造成暂时修复体无法取出；用自凝树脂塑形时不易控制外形等。掌握“暂时冠及印模与模型”知识点。